男性患者59岁，上牙列缺失，右下8健康，近中舌侧倾斜，牙槽嵴丰满，上颌散在骨尖，颌间距离正常。与义齿固位关系最密切的因素是
A. 印模是否准确
B. 颌位记录是否正确
C. 排牙位置是否正确
D. 基托边缘伸展是否正确
E. 选牙是否合适

正确答案：A。印模是否准确

解析：本题考查与义齿固位关系最密切的因素。固位是指义齿抵抗从口内垂直脱位的能力。全口义齿能附着在上下牙槽嵴上是由于吸附力、表面张力和大气压力。保证吸附力、表面张力和大气压力存在的前提是义齿与组织面和黏膜紧密贴合，有良好的边缘封闭。这就要求印模获得精确的义齿承托部位的组织解剖形态，以保证义齿基托与支持组织密合，有良好的固位力。因此，与义齿固位关系最密切的因素是印模是否准确（A对）。基托边缘伸展是否正确（D错）关系到边缘封闭，与全口义齿的固位相关，但不是最密切的因素。颌位记录是否正确（B错）、排牙位置是否正确（C错）、选牙是否合适（E错）与全口义齿的稳定密切相关。